在子宫内的胎儿缺氧早期表现为
A. 胎动减弱
B. 胎动次数减少
C. 胎动增强
D. 胎动频繁
E. 以上都不是

正确答案：D。胎动频繁

解析：胎儿在子宫内因急性或慢性缺氧危及其健康和生命的综合症称为胎儿窘迫。胎儿在子宫内急性缺氧初期表现为胎动频繁（D对），继而胎动减弱（A错）及次数减少（C错）。胎儿在子宫内急性缺氧初期不会出现胎动增强（B错）。